中国药典（一部）规定，必须检查农药残留量的中药材有
A. 大黄
B. 黄连
C. 甘草
D. 黄芪
E. 人参

正确答案：C、D、E。甘草；黄芪；人参

解析：本题考查甘草、黄芪、人参的检查。中国药典（一部）规定，必须检查农药残留量的中药材有甘草（C对）、黄芪（D对）、人参（E对）。甘草【检查】总灰分不得过7.0%，酸不溶性灰分不得过2.0%，水分不得过12.0%；饮片总灰分不得过5.0%。重金属及有害元素。有机氯农药残留。黄芪【检查】总灰分不得过5.0%，水分不得过10.0%。重金属及有害元素。有机氯农药残留。人参【检查】总灰分不得过5.0%，水分不得过12.0%。农药残留量。大黄（A错）【检查】总灰分不得过10.0%；在105℃干燥6小时，减失重量不得过15.0%。土大黄苷。黄连（B错）【检查】总灰分不得过5.0%，水分不得过14.0%；饮片总灰分不得过3.5%，水分不得过12.0%。